关于氟的相关描述，正确的是
A. 人体氟的摄入主要通过饮水从胃肠道吸收
B. 氟具有防龋作用，适量的氟能维持人的牙齿健康
C. 氟摄入过多有毒性作用，造成氟斑牙和氟牙症
D. 骨氟和牙氟含量占体内氟总量的99%
E. 以上均正确

正确答案：E。以上均正确

解析：以上选项描述均正确，故答案为E。掌握“钙、磷、氟”知识点。